男婴，8个月。腹泻伴呕吐3天，无尿6小时。大便10～15次/天，呈蛋花汤样伴黏液，有腥臭味。查体：T37.8℃，表情淡漠，前囟、眼窝明显凹陷，皮肤弹性差，可见花纹，四肢厥冷，双肺呼吸音清，心率120次/分，腹软，无明显压痛。实验室检查：粪镜检偶见白细胞，血钠134mmol/L。患儿输液后出现腹胀，肠鸣音减弱，膝腱反射消失。首先考虑的诊断是
A. 低钾血症
B. 低钙血症
C. 低磷血症
D. 低镁血症
E. 低钠血症

正确答案：A。低钾血症

解析：患儿腹泻伴呕吐，大便10～15次/天，呈蛋花汤样伴黏液，有腥臭味（产毒性大肠埃希菌肠炎的临床表现）。无尿6小时，表情淡漠，前囟、眼窝明显凹陷，皮肤弹性差，可见花纹，四肢厥冷（重度脱水表现），血钠134mmol/L（正常值135～145mmol/L，为等渗性脱水）。根据患者的病史、临床表现和实验室检查，最可能的诊断是产毒性大肠埃希菌肠炎。患儿血钠134mmol/L（正常值135～145mmol/L，为等渗性脱水），不是低钠血症（E错）。患儿严重腹泻，钾从消化道丢失过多，易导致低钾血症（A对）。腹泻时患儿进食少，吸收不良，从大便丢失钙、镁，可合并低钙血症（B错）和低镁血症（D错），但是不如低钾血症常见。腹泻时一般不出现低磷血症（C错）。